某男，25岁，患过敏性鼻炎数年，时易感冒，近日因气温突降，诱发鼻炎，症见鼻痒，喷嚏，流清涕，证属肺气不足，风邪外袭，治当益气固表、祛风通窍。应选用的成药是
A. 藿胆丸
B. 鼻炎康片
C. 辛芩颗粒
D. 千柏鼻炎片
E. 鼻渊舒口服液

正确答案：C。辛芩颗粒

解析：本题考查的是辛芩颗粒的功能。患过敏性鼻炎数年，时易感冒，近日因气温突降，诱发鼻炎，症见鼻痒，喷嚏，流清涕，证属肺气不足，风邪外袭，治当益气固表、祛风通窍。应选用的成药是辛芩颗粒（C对）。辛芩颗粒：【功能】益气固表，祛风通窍。藿胆片（A错）：【功能】芳香化浊，清热通窍。鼻炎康片（B错）：【功能】清热解毒，宣肺通窍，消肿止痛。千柏鼻炎片（D错）：【功能】清热解毒，活血祛风，宣肺通窍。鼻渊舒口服液（E错）：【功能】疏风清热，祛湿通窍。